肠梗阻可见腹痛，并伴有
A. 急性发热
B. 黄疸
C. 呕吐
D. 腹泻
E. 血便

正确答案：C。呕吐

解析：不同原因引起肠梗阻的共同症状为腹痛、呕吐（C对）、腹胀、肛门停止排便排气。腹痛伴急性发热可见于腹膜等（A错）。腹痛伴黄疸可见于胆管阻塞性疾病（B错）。腹痛伴腹泻可见于细菌性痢疾等（D错）。腹痛伴血便可见于肠套叠（E错）。